在吸烟与胃癌的病例对照研究中，如果对照组中选入过多的胃溃疡病人，可能会
A. 高估RR值
B. 高估OR值
C. 低估RR值
D. 低估OR值
E. 对结果影响不大

正确答案：D。低估OR值